咬合
A. 是下颌静止时，上下颌骨间的相对关系
B. 是下颌静止时，上下颌牙的接触
C. 是下颌静止时，上下颌牙弓牙合面最广泛的接触
D. 是下颌运动时，上下颌骨间的相对关系的变化
E. 是下颌运动时，上下颌牙接触的现象

正确答案：E。是下颌运动时，上下颌牙接触的现象

解析：本题考查咬合。咬合是下颌运动时（ABC错），上下颌牙接触的现象（E对D错），习惯上把这种接触关系称为（牙合）关系或咬合关系。在自然牙列存在时，当口腔不咀嚼、不吞咽、不说话时，下颌处于休息的静止状态，上下牙列自然分开，无（牙合）接触，叫做息止颌位。